主要辅料中含有氢氟烷烃等抛射剂的剂型是
A. 气雾剂
B. 醑剂
C. 泡腾片
D. 口腔贴片
E. 栓剂

正确答案：A。气雾剂

解析：本题考查气雾剂的抛射剂。气雾剂（A对）辅料中含有氢氟烷烃等抛射剂；醑剂（B错）指挥发性药物的浓乙醇溶液；泡腾片（C错）指含有机酸和碱式碳酸（氢）盐，置入水中发生泡腾反应的片剂；口腔含片（D错）指通过舌下和口腔颊面粘膜吸收的片剂；栓剂（E错）指药物与适宜的基质制成的具有一定形状供腔道给药的固体外用制剂。